有关疣状癌说法错误的是
A. 无浸润边缘
B. 以老年男性下唇多见
C. 疣状癌呈推进式侵犯间质
D. 约1/2的肿瘤与鳞状细胞癌共存
E. 颊、舌背、牙龈、牙槽黏膜均可发生

正确答案：D。约1/2的肿瘤与鳞状细胞癌共存

解析：本题考查疣状癌。有关疣状癌说法错误的是约1/2的肿瘤与鳞状细胞癌共存（D错，为本题正确答案）。疣状癌以老年男性下唇多见（B对），颊、舌背、牙龈、牙槽黏膜均可发生（E对）。病变开始时为边界清楚、细的白色角化斑块，迅速变厚，发展成钝的乳头状或疣状，表面突起。疣状癌由厚的棒状乳头和具有明显角化的、分化良好的鳞状上皮呈钝性突入间质内构成。鳞状上皮缺乏一般恶性肿瘤的细胞学改变，细胞较鳞状细胞癌中的细胞大，核分裂象少见，且仅位于基底层，有时可见上皮内微小脓肿。疣状癌呈推进式侵犯间质（C对），无浸润边缘（A对）。密集的淋巴、浆细胞是宿主的常见反应。癌周上皮下陷呈杯状包围在疣状癌的周边，这是进行深部活检的理想部位。疣状癌中含有传统的鳞状细胞癌的病灶时则称为杂交瘤。约1/5的肿瘤与鳞状细胞癌共存。